标定下面滴定液所用的基准物质是:硫代硫酸钠滴定液
A. 三氧化二砷
B. 对氨基苯磺酸
C. 无水碳酸钠
D. 重铬酸钾
E. 邻苯二甲酸氢钾

正确答案：D。重铬酸钾